急性坏死性溃疡性龈炎简称
A. AUNG
B. NAUG
C. AUGN
D. ANUG
E. GANU

正确答案：D。ANUG

解析：本题考查坏死性溃疡性龈炎。急性坏死性溃疡性龈炎（简称ANUG）（D对）是指发生于龈缘和龈乳头的急性炎症和坏死。